女，40岁。活动后心悸、气短5年，夜间不能平卧2周，既往有反复关节痛病史。查体：两颊呈紫红色，心尖部可闻及舒张期杂音。最有助于确诊的检查是
A. 血培养+药敏
B. 血常规
C. 胸部X线片
D. 超声心动图
E. 心电图

正确答案：D。超声心动图

解析：患者中年女性，活动后心悸、气短伴夜间不能平卧（提示左心衰竭），既往有反复关节痛病史（提示有风湿热病史），查体：两颊呈紫红色（典型二尖瓣面容），心尖部可闻及舒张期杂音（二尖瓣狭窄特征性杂音），综合患者的临床表现、体格检查，考虑诊断为风湿热导致的二尖瓣狭窄。超声心动图（D对）可观察瓣叶的活动度、瓣叶的厚度、瓣叶是否有钙化以及是否合并其他瓣膜的病变等，是确诊二尖瓣狭窄最敏感可靠的方法。血培养+药敏（A错）一般为感染性疾病的确诊手段，有助于检测本题患者体内的溶血性链球菌，有助于风湿热的诊断，但对二尖瓣狭窄无确诊价值。血常规（B错）是对血液细胞成分的检测，是临床最常规的检查，对本病诊断有一定帮助，但对二尖瓣狭窄的确诊意义不大。胸部X线片（C错）为影像学检查，可见肺部淤血和左心房增大等体征，一般不能用于二尖瓣狭窄的确诊。心电图（E错）主要用于心律失常的诊断，二尖瓣狭窄患者虽可见“二尖瓣型P波”，提示左心房扩大，但并无特异性。